男性，59岁，因右腹股沟斜疝行手术治疗。术中发现疝囊壁的一部分由盲肠组成，此时的诊断为
A. Richtre疝
B. Littre疝
C. 滑动疝
D. 难复性疝
E. 易复性疝

正确答案：C。滑动疝

解析：中年男性患者，右侧腹股沟斜疝术中发现疝囊壁的一部分由盲肠组成（滑动疝的表现），应诊断为滑动疝（C对）。滑动疝指疝囊壁的一部分由盲肠（包括阑尾）、乙状结肠或膀胱组成的疝，属难复性疝；难复性疝（D错）指疝内容物不能回纳或不能完全回纳入腹腔内，但并不引起症状者，综上，该患者诊断为滑动疝更为准确。Richter疝（A错）又称肠管壁疝，指疝内容物为部分肠壁，系膜侧肠壁及其系膜未进入疝囊，肠腔未完全梗阻的疝；Littre疝（B错）指疝内容物为小肠憩室（通常是Meckel憩室）的疝，上述两者均属嵌顿性疝。易复性疝（E错）指疝内容物疝内容物很容易回纳入腹腔内的疝，该患者的腹股沟斜疝需行手术治疗，故不能诊断为易复性疝。